天花粉的药用部位是
A. 块根
B. 全草
C. 花粉
D. 果实
E. 种子

正确答案：A。块根

解析：天花粉为葫芦科植物栝楼或双边栝楼的干燥根（A对）。药用部分为全草（B错）的中药有紫花地丁、金钱草、半枝莲等。药用部分为花粉（C错）的中药有蒲黄、松花粉等。药用部分为果实（D错）的中药有地肤子、五味子、木瓜、山楂等。药用部分为种子（E错）的中药有桃仁、杏仁、葶苈子等。